编制统计表时，做法错误的是
A. 同一指标的小数位数保留保持一致
B. 表内数据一律用阿拉伯数字表示
C. 统计表需要有标题
D. 表中必须含有竖线
E. 表中若缺或未记录可用“…”表示

正确答案：D。表中必须含有竖线

解析：编制统计表时，同一指标的小数位数保留保持一致（A对），表内数据一律用阿拉伯数字表示（B对），统计表需要有标题（C对），表中不宜使用竖线和斜线（D错，为本题正确答案），表中若缺或未记录可用“…”表示（E对）